患儿，8岁。身体痩弱，汗出较多，心烦少寐，寐后汗多，低热，口干，手足心热，唇舌色淡，脉细弱。治疗应首选
A. 人参五味子汤
B. 当归六黄汤
C. 黄芪桂枝五物汤
D. 生脉散
E. 玉屏风散

正确答案：D。生脉散

解析：患儿以汗出较多为主症，故可诊断为汗证。根据“汗出较多，唇舌色淡，脉弱”，可辨证为气虚；根据“心烦少寐，寐后汗多，低热，口干，手足心热，脉细”，可辨证为阴虚。故此为气阴两虚证——素体气阴两虚，故身体瘦弱；气虚不能敛阴，阴虚易生内热，迫津外泄，故汗出较多，伴低热，口干、手足心热；唇舌色淡，脉细弱为气阴虚弱之象。故当治以益气养阴，应首选生脉散加味（D对）。人参五味子汤（A错）其功用为益气健脾，适用于久嗽脾虚，中气怯弱，面白唇白者。当归六黄汤（B错）其功用为滋阴泻火，固表止汗，适用于阴虚火旺之盗汗。黄芪桂枝五物汤（C错）其功用为益气温经，和血通痹，适用于汗证之营卫失和证。玉屏风散（E错）其功用为益气固表止汗，适用于汗证之肺卫不固证。